关于乳牙龋损临床表现描述哪项是错误的
A. 患龋率高，发病早
B. 龋齿多发，龋蚀范围广
C. 龋蚀发展速度快
D. 修复性牙本质的形成不活跃
E. 自觉症状不明显

正确答案：D。修复性牙本质的形成不活跃

解析：本题考查乳牙龋损的临床表现。乳牙龋与恒牙龋相比，乳牙龋的临床表现有其特异性：1.修复性牙本质形成活跃（D错，为本题的正确答案）；2.患龋率高，发病时间早（A对），乳牙尚未完全萌出就可发生龋；3.龋病发展速度快（C对），其原因是乳牙幼稚薄且矿化程度低；4.乳牙龋进展快，所以往往自觉症状不明显（E多），易忽略；5.龋齿多发，龋坏范围广（B对）。